以下哪些与盐酸赛庚啶相符
A. 味苦
B. 与甲醛硫酸试液反应呈灰色
C. 具H₁受体拮抗作用
D. 可以治疗消化道溃疡
E. 白色结晶性粉末

正确答案：A、B、C、E。味苦；与甲醛硫酸试液反应呈灰色；具H₁受体拮抗作用；白色结晶性粉末